某女，15岁。1月前因急性阑尾炎而住院手术治疗，刀口愈合良好。出院后出现便秘，4至5日排便1次。服通便西药乏效遂来求治，刻下除便秘外，又见食欲不佳，脘腹胀满，口干口苦饮水多，喜食凉酸之物，乏力，月经正常，舌红，苔薄白、微腻，脉滑数。证属热结便秘气滞湿阻。治以泻热通肠行气化湿。药用制大黄10g，枳实10g，瓜蒌30g，郁李仁12g（打碎），佩兰10g，陈皮10g，炒神曲12g，生白术10g。3剂，每日1剂水煎服。忌食辛辣油腻宜多食蔬菜。二诊，大便仍干，3日1行。纳增，脘胀减，食后嗳气，口微苦而干，舌红苔薄黄腻，脉弦滑。原方改制大黄为生大黄10g（后下），去郁李仁、炒神曲，加决明子30g（打碎），厚朴6g，炒莱菔子12g（打碎），清半夏10g，续进3剂。医师为增强制大黄的泻热通肠之力，首诊方即配用了大剂量的瓜蒌，二诊方又去郁李仁，加适量的决明子，此因瓜蒌与决明子均能
A. 养血，润肠通便，善治肠燥便秘
B. 生津，润肠通便，善治肠燥便秘
C. 清热，润肠通便，善治肠燥便秘
D. 滋阴，润肠通便，善治津枯肠燥便秘
E. 行气，润肠通便，善治热结肠燥便秘

正确答案：C。清热，润肠通便，善治肠燥便秘

解析：本题考查的是瓜蒌与决明子的功效与主治病证。瓜蒌与决明子均能清热，润肠通便，善治肠燥便秘（C对）。瓜蒌：【功效】清肺润燥化痰，利气宽胸，消肿散结，润肠通便。【主治病证】（1）肺热咳嗽、痰稠不易咳出。（2）胸痹，结胸。（3）乳痈肿痛，肺痈，肠痈。（4）肠燥便秘。决明子：【功效】清肝明目，润肠通便。【主治病证】（1）肝热或肝经风热之目赤肿痛、羞明多泪，目暗不明。（2）热结肠燥便秘。麦冬：【功效】润肺养阴，益胃生津，清心除烦，润肠通便。【主治病证】（1）肺热燥咳痰黏，阴虚劳嗽咯血。（2）津伤口渴，内热消渴。（3）心阴虚、心火旺之心烦失眠。（4）肠燥便秘（B错）。天冬：【功效】滋阴降火，清肺润燥，润肠通便。【主治病证】（1）肺热燥咳，顿咳痰黏，劳嗽咯血。（2）骨蒸潮热，津伤口渴，阴虚消渴。（3）肠燥便秘（D错）。功效与主治病证为养血，润肠通便，善治肠燥便秘（A错）或行气，润肠通便，善治热结肠燥便秘（E错）的中药，2022年考试指南未明确说明。